女，45岁。同房后阴道流血3个月，G5P1。妇科检查：宫颈重度糜烂状，下唇息肉样赘生物，直径2cm。三合诊宫颈旁组织无异常。取宫颈赘生物送病理，提示宫颈鳞癌。首选的治疗方法是
A. 子宫颈切除+盆腔淋巴结切除术
B. 筋膜外子宫切除术
C. 根治性放疗
D. 广泛性子宫切除+盆腔淋巴结切除术
E. 宫颈锥形切除术

正确答案：D。广泛性子宫切除+盆腔淋巴结切除术

解析：患者妇科检查：宫颈重度糜烂状，下唇息肉样赘生物，直径2cm（肉眼可见），三合诊宫颈旁组织无异常（提示病变局限于子宫颈），取宫颈赘生物送病理，提示宮颈鳞癌，根据表29-1 子宫颈癌临床分期（FIGO，2009年）（P308）：所有肉眼可见的病灶，包括浅表浸润，均为ⅠB期，且临床癌灶≤4为ⅠB1期，ⅠB1期的手术方式为广泛性子宫切除+盆腔淋巴结切除术（D对）。子宫颈切除+盆腔淋巴结切除术（P308）（A错）适用于肿瘤直径＜2cm的ⅠB1期且要求保留生育功能的年轻患者。筋膜外子宫切除术（B错）适用于ⅠA1期。根治性放疗（C错）不是首选治疗方法，放疗常用于术前应用缩小切除范围或全身状况不适宜手术的早期患者以及术后辅助治疗。宫颈锥形切除术（E错）适用于对要求保留生育功能的ⅠA1期年轻患者。